在四行三列表χ²检验中，统计量χ²的自由度等于
A. 2
B. 3
C. 4
D. 6
E. 12

正确答案：D。6